欲对某地25名7～10岁儿童体重与肺活量回归系数进行假设检验，不可采用
A. 回归系数t检验法
B. 回归系数F检验法
C. 相关系数t检验法
D. 查相关系数界值表法
E. 回归系数的秩和检验

正确答案：E。回归系数的秩和检验